下列关于职业卫生标准的叙述错误的是
A. 有助于改善作业环境
B. 是促进工人健康的保证
C. 是安全与有害的绝对界限
D. 只是一种限量标准
E. 不能作为是否损害健康的判定依据

正确答案：C。是安全与有害的绝对界限